完成瘢痕性修复的物质基础是
A. 上皮组织
B. 肉芽组织
C. 毛细血管网
D. 纤维蛋白网架
E. 炎性渗出物

正确答案：B。肉芽组织

解析：瘢痕性修复即损伤部位瘢痕组织的形成，而瘢痕组织是由肉芽组织改建成熟而成的，故肉芽组织（B对）是瘢痕性修复的物质基础。上皮组织（A错）是由密集排列的上皮细胞和极少量细胞间质构成的基本组织。毛细血管网（C错）由新生毛细血管相互吻合构成。纤维蛋白网架（D错）的形成是肉芽组织逐渐成熟并转化为瘢痕组织的标志之一。炎性渗出物（E错）常见于炎症并发感染时。